把1，4-苯并二氮卓类药物制成水溶性前药，对其结构修饰的方法是
A. 成环
B. 开环
C. 扩环
D. 酰化
E. 成盐

正确答案：B。开环